牙周病的基础治疗，说法错误的是
A. 正确刷牙和洁治术
B. 洁治术和刮治术
C. 刮治术和根面平整
D. 服用消炎药和使用含漱液
E. 口腔卫生宣教和定期的洁治术

正确答案：E。口腔卫生宣教和定期的洁治术

解析：本题考查牙周病的基础治疗。牙周病的基础治疗，说法错误的是口腔卫生宣教和定期的洁治术（E错，为本题正确答案）。定期的洁治术为牙周治疗的第四阶段，即支持治疗。牙周病的基础治疗即牙周病治疗计划的第一阶段，包括教育并指导患者自我控制菌斑的方法，如建立正确的刷牙方法和习惯；施行洁治术和根面平整术（ABC对）；药物治疗（D对）。